大青叶的功效为
A. 清热解毒，消痈散结
B. 清热解毒，凉血消斑
C. 清热解毒,利湿
D. 清热解毒,散结止痛
E. 清热解毒，凉血消肿

正确答案：B。清热解毒，凉血消斑

解析：大青叶的功效是清热解毒，凉血消斑（B对），可用于治疗热入营血，温毒发斑，喉痹口疮，痄腮丹毒。